可作为银杏黄酮质量控制标准的是
A. 黄芩苷
B. 木樨草素
C. 大豆素
D. 杜鹃素
E. 金丝桃苷

正确答案：B。木樨草素